脊神经根的说法中,何者错误
A. 前、后根均由神经纤维组成
B. 后根膨大处称脊神经节
C. 脊神经根由上而下增长
D. 腰、骶、尾脊神经根垂直或近于垂直向下
E. 形成马尾的是骶,尾脊神经根

正确答案：E。形成马尾的是骶,尾脊神经根

解析：脊神经前根由运动性神经根丝构成，后根由感觉性神经根丝构成（A对）。脊神经后根在椎间孔处有椭圆形的膨大，称脊神经节（B对）,其中含有假单极感觉神经元。不同部位的脊神经前、后根在椎管内的走行方向和走行距离有明显差别。颈神经根最短，行程近于水平，胸神经根较长，斜向外下走行，腰神经根最长，几近垂直下（CD对）。马尾由腰、骶、尾部的脊神经根汇合而成（E错，为本题正确选项）。